医务人员在环境保护中，道德责任的表现
A. 自觉遵守刑事、民事法规
B. 加强对社会性污染的监测、管理的道德责任
C. 坚持眼前利益服从长远利益，物质与精神同步建设的道德责任
D. 适当允许先生产后污染治理、实现环境与经济同步发展的道德责任
E. 少数服从多数利益，认真履行环境道德的社会责任

正确答案：C。坚持眼前利益服从长远利益，物质与精神同步建设的道德责任